一般注射液的pH值为
A. 3～8
B. 3～10
C. 4～9
D. 5～10
E. 4～11

正确答案：C。4～9

解析：本题考查注射剂。注射剂的pH应和血液的pH相等或相近，血液的pH值为7.4，故注射剂的pH值一般控制在4～9（C对）的范围内，也可以根据具体品种确定，同一品种的pH允许差异范围不超过±1.0。